若从颜色分辨器械的号码，则紫色应对应的是
A. 30号锉
B. 25号锉
C. 15号锉
D. 10号锉
E. 6号锉

正确答案：D。10号锉

解析：在15号锉之前还有06号、08号、10号三根细锉，颜色分别为粉色、灰色和紫色。掌握“髓腔进入与初预备”知识点。